对于消化性溃疡合并湿热的患者会诱发溃疡、出血、穿孔的药物有
A. 阿司匹林
B. 青霉素
C. 泼尼松
D. 四环素
E. 保泰松

正确答案：A、C、E。阿司匹林；泼尼松；保泰松

解析：本题考查消化道溃疡。对于消化性溃疡合并湿热的患者会诱发溃疡、出血、穿孔的药物有阿司匹林（A对）、泼尼松（C对）和保泰松（E对）。青霉素（B错）和四环素（D错）是广谱抗菌药，没有此类影响。